男，35岁。双下肢水肿2周。查体BP130/80mmHg，双下肢凹陷性水肿。尿常规蛋白（+++），红细胞（++）。血浆白蛋白28g/L，Scr78umol/L。尿蛋白定量3.6g/天。肾活检示肾小球系膜轻度增生，系膜区可见免疫复合物沉积。首选的治疗药物为
A. 糖皮质激素
B. 环孢素A
C. 霉酚酸酯
D. 血管紧张素转化酶抑制剂
E. 环磷酰胺

正确答案：A。糖皮质激素

解析：患者初步诊断为肾病综合征。肾活检诊断为轻度系膜增生性肾小球肾炎。临床表现为肾病综合症的轻度系膜增生性肾小球肾炎，对糖皮质激素及细胞毒药物的治疗疗效好。一般首选糖皮质激素（A对）。细胞毒药物多在患者呈现“激素依赖型”或“激素抵抗型”加用，若无激素禁忌，一般不作为首选或单独治疗用药，环磷酰胺（E错）是细胞毒药物，故不选。环孢素A（B错）、霉酚酸酯（C错）均为免疫抑制剂，已作为二线药物用于治疗激素及细胞毒药物无效的难治性肾病综合征（P476）。血管紧张素转化酶抑制剂（D错）仅作为一般对症治疗，可减轻蛋白尿（P476），不如糖皮质激素作用广泛，不作为首选治疗。